老年人服用后易导致出血的是
A. 华法林
B. 乳酸钙
C. 青霉素
D. 氨曲南
E. 地西泮

正确答案：A。华法林

解析：本题考查老年人用药。老年人服用华法林（A对）后易致出血。华法林的蛋白结合率高，而老年人血浆蛋白降低，使血中游离药物比结合型药物多，常规用量就有出血的危险。乳酸钙（B错）用于防治钙缺乏症。氯霉素（C错）不良反应为再生障碍性贫血。氨曲南（D错）具有肾毒性、免疫原性弱以及青霉素类、头孢菌素类交叉过敏少等特点。地西泮（E错）不良反应为中枢神经系统抑制。